妊娠期孕妇循环系统改变，下述哪项是错误的
A. 妊娠后期心脏向左、上、前方移位
B. 心脏容量到妊娠末期增加10%
C. 心率在妊娠末期增加10～15次/分
D. 妊娠30～32周，血容量约增加达高峰
E. 妊娠晚期血压轻度升高

正确答案：D。妊娠30～32周，血容量约增加达高峰

解析：循环系统的变化妊娠后期因膈肌升高，心脏向左、上、前方移位。心脏容量至妊娠末期约增加10%，心率于妊娠晚期休息时每分钟增加10～15次。心排出量自妊娠10周逐渐增加，至妊娠32～34周达高峰。临产后在第二产程心排出量显著增加。血压在妊娠早期及中期血压偏低，在妊娠晚期血压轻度升高。一般收缩压无变化，舒张压轻度降低，使脉压稍增大。掌握“妊娠生理”知识点。